以下哪项不是在诊疗过程中，医务人员对患者的自主权主要体现
A. 为患者自主选择提供充分条件
B. 医生的诊疗措施与患者自主选择发生矛盾时，应遵循医生选择的对策
C. 正确对待患者的拒绝
D. 耐心说服患者不合理的要求
E. 患者拒绝诊疗措施时，要对病人自主选择能力进行判断，确定患者拒绝是否有效

正确答案：B。医生的诊疗措施与患者自主选择发生矛盾时，应遵循医生选择的对策